某男，40岁。患热结肠燥便秘3年，近日又患肝热目赤肿痛、羞明多泪。宜选用的药是
A. 谷精草
B. 夏枯草
C. 青葙子
D. 木贼
E. 决明子

正确答案：E。决明子

解析：本题考查的是决明子的主治病证。患热结肠燥便秘3年，近日又患肝热目赤肿痛、羞明多泪。宜选用的药是决明子（E对）。决明子：【主治病证】（1）肝热或肝经风热之目赤肿痛、羞明多泪，目暗不明。（2）热结肠燥便秘。谷精草（A错）：【主治病证】（1）风热目赤，肿痛羞明，目生翳膜。（2）风热头痛。夏枯草（B错）：【主治病证】（1）肝阳或肝火上升之头目眩晕。（2）目赤肿痛，目珠夜痛。（3）痰火郁结之瘰疬、瘿瘤。青葙子（C错）：【主治病证】肝火上炎，目赤肿痛，目生翳膜。木贼（D错）：【主治病证】（1）风热目赤，迎风流泪，翳障。（2）血热下血。